患者，男，28岁，2天前因淋雨后出现发热，体温最高达39℃，经实验室和胸片检查，临床诊断为社区获得性肺炎，无其他基础疾病。可首选的抗菌药物是
A. 头孢拉定
B. 阿米卡星
C. 亚胺培南西司他丁
D. 头孢哌酮舒巴坦
E. 甲硝唑

正确答案：A。头孢拉定

解析：本题考查社区获得性肺炎治疗药物的选用。可首选的抗菌药物是头孢拉定（A对）。可选用β-内酰胺类抗生素和喹诺酮类抗菌药，但首选β-内酰胺类抗生素，对于耐药者，选择喹诺酮类抗菌药。头孢拉定为β-内酰胺类的第一代头孢菌素类抗生素，适用于青壮年和无基础疾病的CAP患者。亚胺培南西司他丁（C错）、甲硝唑（E错）用于重症肺炎。阿米卡星（B错）因其毒性大，不作为首选。头孢哌酮舒巴坦（D错）是第三代头孢菌素类药物，用于治疗老年人、有基础疾病或需要住院的CAP或医院获得性肺炎。